符合合理用药原则的有
A. 尽量减少用药剂量，以减轻不良反应
B. 能用一种药物治愈的疾病不联合用药
C. 充分考虑用药后的效益与风险等因素，制定最佳方案
D. 在辨析病证不确定时，为防意外先预防用药
E. 准确辨证，正确选择药物

正确答案：B、C、E。能用一种药物治愈的疾病不联合用药；充分考虑用药后的效益与风险等因素，制定最佳方案；准确辨证，正确选择药物